以下都是对自然灾害期间搭建临时厕所的要求，除外
A. 尽量选择地势较高，且位于安置点的上风向的地方
B. 距水源至少30m以上
C. 蹲位数应能满足需求，至少每45人设置1个蹲位
D. 厕坑应做到坑深、口小、不渗、不漏，能防蝇、防蛆
E. 粪便采用高温堆肥法或密封发酵法处理，达到无害化卫生要求

正确答案：A。尽量选择地势较高，且位于安置点的上风向的地方

解析：本题考查自然灾害期间搭建临时厕所的要求。自然灾害期间搭建临时厕所的要求有：1.搭建临时厕所要选择地势较高，距水源至少30m以上（B对），且位于安置点的下风向（A错，为本题正确答案），周围挖有排水沟。大便蹲位数应能满足需求，至少为每45人设置l个蹲位（C对）。2.厕坑应做到坑深、口小、不渗、不漏，能防蝇、防蛆（D对），粪坑满时应及时清理，减少蚊蝇孽生。3.水灾时，尽翟利用现有储粪设施来储存粪便。 如无储粪设施，可采用大容量塑料桶、木桶等收集粪便，装满后加盖，送到指定地点暂存，待水灾过后运出处理。4.粪便采用高温堆肥法或密封发酵法处理，达到无害化卫生要求（E对）。5.肠道传染病患者的粪便必须用专用容器收集，然后作特殊消毒处理。